急性淋巴管炎相当于中医学的
A. 烂疔
B. 疫疔
C. 红丝疔
D. 蛇头疔
E. 蛇眼疔

正确答案：C。红丝疔

解析：浅部急性淋巴管炎中医称为“红丝疔”（C对）。烂疔（A错）是一种发于皮肉之间，易于腐烂，病势凶险的急性传染性疾病。发病者有手足等部位的创伤和泥土脏物等接触史，发病急骤，皮肉腐败，腐烂卸脱，容易合并走黄，危及生命，相当于西医的气性坏疽。疫疔（B错）是皮肤接触疫畜染毒而生的一种急性传染性疾病。脓性指头炎是手指末节掌面皮下组织的化脓性感染，中医称为“蛇头疔”（D错）。疔毒发生于指甲两旁，形如蛇眼者，称“蛇眼疔”相当于西医的甲沟炎（E错）。